引起尖锐湿疣的病原体是
A. 人免疫缺陷病毒
B. 人乳头瘤病毒
C. EB病毒
D. 水痘-带状疱疹病毒
E. 巨细胞病毒

正确答案：B。人乳头瘤病毒

解析：人乳头瘤病毒（HPV）主要引起人类皮肤黏膜的增生性病变，低危性HPV（6型、11型等）引起生殖器尖锐湿疣（B对），高危型HPV（16型、18型等）与子宫颈癌等恶性肿瘤的发生密切相关。人类免疫缺陷病毒（HIV）（A错）是获得性免疫缺陷综合征即艾滋病（AIDS）的病原体（P305）。EB病毒（EBV）（C错）原发性感染者中约有半数表现为传染性单核细胞增多症，与非洲儿童恶性淋巴瘤和鼻咽癌的发病密切相关（C错），目前认为EBV是一种人类重要的肿瘤相关病毒（P300）。水痘-带状疱疹病毒（VZV）（D错），是引起水痘和带状疱疹的病原体（P297）。巨细胞病毒（E错）在人群中的感染极为普遍，原发感染发生在2岁以下，通常为隐性感染，仅少数患者出现临床症状，在机体免疫功能低下时易发生显性感染，表现为巨细胞病毒单核细胞增多症，巨细胞病毒是引起先天性畸形最常见的病原（P299）。